肺通气的原动力是
A. 呼吸运动
B. 胸内压的变化
C. 肋间内肌与外肌的收缩
D. 胸内压与肺内压之差
E. 肺内压与大气压之差

正确答案：A。呼吸运动